1990年8月，某远洋客轮上发生一起军团病爆发流行。船离开港口时载有350名乘客、50名船员。8月1日前的一周内，在一次风暴中有七分之一的乘客遇难。8月份第一周中，船上有30人发生军团病，其中一半很快死亡。随后的一周内又有20人发病，但无死亡。假设症状持续一个月。8月1日至14日，军团病的累积发病率是（以8月1日凌晨零点零1分时船上人口作为危险人群）
A. 0.1
B. 0.125
C. 0.143
D. 用该资料不能计算
E. 以上答案均不是

正确答案：C。0.143

解析：本题考查累积发病率的计算。累积发病率的计算公式为：观察期内的发病人数/观察开始时的人数＝（30＋20）/（350－350/7＋50）＝0.143（C对ABDE错）。